脑干胶质瘤最早临床表现是
A. 颅神经麻痹
B. 脑积水
C. 头痛
D. 癫痫
E. 视神经盘水肿

正确答案：A。颅神经麻痹

解析：脑干胶质瘤主要为神经胶质瘤，其中以星形细胞瘤和极性成胶质细胞瘤较为多，最早出现的症状为脑组织受肿瘤的压迫、浸润、破坏所产生的局部症状，如颅神经麻痹（A对），病变逐渐发展后出现颅内压增高等表现，如脑积水（B错）、头痛（C错）、癫痫（D错）、视乳头水肿（E错）等。